抗过敏性休克时首选
A. 肾上腺素
B. 麻黄碱
C. A和B均是
D. A和B均不是

正确答案：A。肾上腺素

解析：本题考查过敏性休克的首选药。抗过敏性休克时首选肾上腺素（A对）。过敏性休克主要由于小血管扩张和毛细血管通透性增加而引起血压下降，支气管痉挛及黏膜水肿出现呼吸困难。肾上腺素能收缩血管，兴奋心脏，升高血压，缓解呼吸困难，迅速解除休克症状，是过敏性休克的首选药。麻黄碱（B错）主要预防支气管哮喘发作和缓解轻度哮喘发作，不是过敏性休克的首选药。